对于能够去净龋腐的急性龋，且牙髓状况正常的急性深龋洞，其最佳治疗方法为
A. 安抚
B. 垫底充填
C. 间接盖髓术
D. 直接盖髓术
E. 根管治疗术

正确答案：B。垫底充填

解析：本题考查龋病的治疗原则与非手术治疗方法。对于软龋能够去净且牙髓状况正常的急性深龋洞，其最佳的治疗方案为垫底充填（B对）。